女，2岁。出生时正常，母乳喂养，5个月后智能渐落后，头发变黄，肤色变白，有时发生抽搐，肌张力增高。为协助诊断应选择的检查是
A. 染色体核型分析
B. 血钙测定
C. 脑电图检查
D. 尿三氯化铁试验
E. 血T₃、T₄、TSH测定

正确答案：D。尿三氯化铁试验

解析：患儿智能落后、抽搐、肌张力增高，提示有神经系统病变；头发发黄、肤色变白，提示黑色素合成不足，两者均为苯丙酮尿症患儿的标志性临床表现。该患儿已经2岁，苯丙氨酸代谢旁路已经建立，因此选择尿三氯化铁试验进行协诊最为合适（D对）。